患者，男性，68岁，右下牙龈癌，拟行颌颈联合根治术+胸大肌、肋骨复合组织瓣修复术。该患者需行正颌外科手术，术前最主要行
A. 牙周检查
B. 正畸治疗
C. 龋齿治疗
D. 心理治疗
E. 颞颌关节病治疗

正确答案：B。正畸治疗

解析：本题考查正颌外科的治疗程序。该患者需行正颌外科手术，术前最主要行正畸治疗（B对）。正颌外科的治疗程序如下：一、术前正畸治疗：正颌外科患者术前正畸治疗的目的不是用正畸手段来矫正牙颌畸形，而是为成功施行正颌外科手术做准备的，因此其矫治原则与一般的正畸治疗并不一样；二、正颌外科手术；三、术后正畸与康复治疗；四、随访观察。